下列中何项不属于房事养生的运用原则
A. 禁欲或纵欲
B. 注意房事卫生
C. 遵守房事禁忌
D. 杜绝性生活混乱
E. 节欲

正确答案：A。禁欲或纵欲

解析：保养肾精的原则，首重于节欲保精，使精气充盛，有利于心身健康。节欲并非禁欲，乃房事有节之谓。若恣情纵欲，施泄过多，则精液桔竭，真气耗散而未老先衰（A对）。